男，62岁。上腹部隐痛1年，进食后呕吐20天，呕吐物含有宿食。查体：贫血貌，消瘦，上腹部可见胃型，可闻及振水音。最有价值的辅助检查是
A. 腹部CT
B. 腹部彩超
C. 腹部X线平片
D. 胃镜
E. X线钡剂造影

正确答案：D。胃镜